质量要求中需要进行微细粒子剂量检查的制剂是
A. 吸入制剂
B. 眼用制剂
C. 栓剂
D. 口腔黏膜给药制剂
E. 耳用制剂

正确答案：A。吸入制剂

解析：本题考查进行微细粒子剂量检查的制剂。吸入制剂（A对）应为无菌制剂，应进行微细粒子剂量、递送剂量均一性、每瓶总喷数和每喷药物含量的检查；眼用制剂（B错）、栓剂（C错）、口腔黏膜给药制剂（D错）、耳用制剂（E错）均不需要进行微细粒子剂量检查。